气出入受阻，突然昏厥的病理变化为
A. 气虚
B. 气滞
C. 气逆
D. 气闭
E. 气脱

正确答案：D。气闭

解析：气机闭阻，外出严重障碍，气出入受到阻碍以致清窍闭塞，所以出现昏厥这种病理状态（D对）。气虚，指一身之气不足及其功能低下的病理状态，气虚常见精神萎顿、倦怠乏力、眩晕、自汗、易于感冒、面色晄白、舌淡、脉虚等症状（A错）。气滞，是指机体局部气的流畅不畅，郁滞不通的病理状态（B错）。气逆，指气升之太过，或降之不及以脏腑之气逆上为特征的一种病理状态（C错）。气脱，即气不内守，大量向外亡失，以致生命机能突然衰竭的一种病理状态（E错）。